根据《处方药和非处方药分类管理办法（试行）》，非处方药的标签和说明书的批准部门是
A. 国家药品监督管理局
B. 国家药典委员会
C. 卫生部
D. 省级药品监督管理部门
E. 省级卫生行政部门

正确答案：A。国家药品监督管理局

解析：本题考查处方药和非处方药分类管理办法。根据《处方药和非处方药分类管理办法（试行）》，非处方药的标签和说明书的批准部门是国家药品监督管理局（A对）。《处方药与非处方药分类管理办法（试行）》第六条：非处方药标签和说明书除符合规定外，用语应当科学、易懂，便于消费者自行判断、选择和使用。非处方药的标签和说明书必须经国家药品监督管理局批准。